属于长效苯二氮䓬类药物的是
A. 三唑仑、唑吡坦
B. 替马西泮、扎来普隆
C. 艾司唑仑、劳拉西泮
D. 氟西泮、地西泮
E. 唑吡坦、夸西泮

正确答案：D。氟西泮、地西泮

解析：本题考查长效苯二氮䓬类药物。长效苯二氮䓬类药物包括氟西泮、夸西泮以及地西泮（D对）。